9岁患儿，每晚睡前吃饼干，进来发现牙齿上有洞，但无疼痛感，前来就诊。经过医生诊断为
A. 乳牙浅龋
B. 乳牙深龋
C. 恒牙浅龋
D. 恒牙深龋
E. 龋齿继发牙周炎

正确答案：C。恒牙浅龋